口服避孕药副反应不包括
A. 短期闭经
B. 体重增加
C. 卵巢肿瘤
D. 类早孕反应
E. 色素沉着

正确答案：C。卵巢肿瘤

解析：口服避孕药的副反应有：1.类早孕反应（D对）；2.不规则阴道流血；3.闭经（A对）；4. 体重及皮肤变化 早期研制的避孕药中其雄激素活性强，个别妇女服药后食欲亢进，体内合成代谢增加，体重增加（B对），极少数妇女面部出现淡褐色色素沉着（E对）；5.其他 个别妇女服药后出现头痛、复视、乳房胀痛等。口服避孕药副反应不包括卵巢肿瘤（C错，为本题正确答案），反而流行病学调查显示口服避孕药是卵巢上皮性癌的保护因素，高危妇女可通过口服避孕药预防卵巢癌发生（P325）。